在燃煤污染型砷中毒病区，含砷量超过多少可判定为高砷煤
A. 10mg/kg
B. 20mg/kg
C. 50mg/kg
D. 100mg/kg
E. 200mg/kg

正确答案：B。20mg/kg

解析：本题考查高砷煤含砷量的判定。在燃煤污染型砷中毒病区，含砷量超过20mg/kg（B对ACDE错）可判定为高砷煤。凡以砷含量大于100mg/kg的高砷煤为燃料可定为燃煤污染型地方性砷中毒地区。